结核分枝杆菌化学组成最显著的特点是含有大量的
A. 蛋白质
B. 脂类
C. 多糖
D. RNA
E. 磷壁酸

正确答案：B。脂类